与鼻腔相通
A. 破裂孔
B. 内耳门
C. 圆孔
D. 颈静脉孔
E. 筛孔

正确答案：E。筛孔

解析：筛板上有筛孔通鼻腔（E对）。